患儿，1岁。体重10kg，身长65cm，前囟未闭，后囟已闭，乳牙萌出6颗。应考虑的是
A. 体重低下
B. 身长低下
C. 囟门早闭
D. 囟门晚闭
E. 出牙过晚

正确答案：B。身长低下

解析：1岁正常儿童身高应为75cm，而患儿身长只有65cm，为身长低下（B对）。1岁正常儿童体重为10kg，患儿体重正常（A错）。前囟应在小儿出生后的12-18个月闭合，患儿前囟还未闭，非囟门早闭（C错）。后囟在部分小儿出生时就已闭合，未闭合者应在生后2-4个月内闭合，非囟门晚闭（D错）。1岁正常儿童乳牙数应为8颗或者6颗，非出牙过晚（E错）。